女，27岁，检查：全口牙龈增生覆盖牙冠的1/3～1/2。诊断为药物性牙龈增生，关于牙龈增生的原因，哪一项不正确
A. 成纤维细胞的分裂活动增加
B. 无活性胶原溶解酶分泌增加
C. 与原有牙龈炎症无关
D. 合成大于降解
E. 合成胶原的能力增强

正确答案：C。与原有牙龈炎症无关

解析：本题考查药物性牙龈肥大牙龈增生的原因。诊断为药物性牙龈增生，关于牙龈增生的原因不正确的是与原有牙龈炎症无关（C错，为本题的正确答案）。研究表明，菌斑引起的牙龈炎症可能促进药物性牙龈增生的发生，长期服用相关药物可使原来已有炎症的牙龈发生纤维性增生。体外研究表明：苯妥英钠可刺激成纤维细胞的有丝分裂（A对），使蛋白合成增加，合成胶原的能力增强（E对），同时细胞分泌的胶原溶解酶丧失活性（B对），致使胶原的合成大于降解（D对），结缔组织增生肿大。